因证候禁忌而不宜合用的药组是
A. 理中丸与健脾丸
B. 金锁固精丸与参苓白术丸
C. 胆宁片与苏合香丸
D. 附子理中丸与牛黄解毒片
E. 参芪丸与柏子养心丸

正确答案：D。附子理中丸与牛黄解毒片

解析：本题考查的是中成药联用的配伍禁忌和证候禁忌。因证候禁忌而不宜合用的药组是附子理中丸与牛黄解毒片（D对）。附子理中丸与牛黄解毒片联用，附子理中丸系温中散寒之剂，适用于脾胃虚寒所致的胃脘痛、呕吐、腹泻等；而牛黄解毒片性质寒凉，为清热解毒泻火之剂，适用于火热毒邪炽盛于内而上扰清窍者，可见不加分析地盲目将两者合用是不适宜的。胆宁片与苏合香丸（C错）含配伍禁忌，不宜联用。利胆中成药利胆排石片、胆乐胶囊、胆宁片等都含有郁金，若与六应丸、苏合香丸、妙济丸、纯阳正气丸、紫雪散等含丁香（母丁香）的中成药同时使用，就要注意具“十九畏”药物的禁忌。理中丸与健脾丸（A错）、金锁固精丸与参苓白术丸（B错）、参芪丸与柏子养心丸（E错）联用的效果，2022年考试指南未明确说明。